以下说法哪个是正确的
A. 反映健康相关生命质量的指标常常是客观指标
B. 健康相关生命质量包含了身体功能、心理能力和社会适应能力三个方面
C. 健康相关生命质量的评价主体是医生、护士和流行病学家
D. 健康相关生命质量大多采用临床诊断和实验室检查结果
E. 健康相关生命质量随时间的变化而变化

正确答案：E。健康相关生命质量随时间的变化而变化